能引起继发性高甘油三酯血症的疾病有
A. 肾病综合征
B. 柯兴氏综合征
C. 系统红斑狼疮
D. 甲状腺功能减退症
E. 痛风

正确答案：A、D。肾病综合征；甲状腺功能减退症

解析：本题考查继发性高脂血症。可引起血脂升高的系统性疾病主要有糖尿病、肾病综合征（A对）、甲状腺功能减退症（D对）等。